义齿基托组织面不可做缓冲的部位是
A. 上颌结节颊侧
B. 上颌硬区
C. 下颌隆突
D. 磨牙后垫
E. 内斜嵴

正确答案：D。磨牙后垫

解析：缓冲区主要指无牙颌上的上颌隆突、颧突、上颌结节的颊侧、切牙乳突、下颌隆突、下颌舌骨嵴以及牙槽嵴上的骨尖、骨棱等部位，上面覆盖很薄的黏膜，为防止压痛，与之相对的基托组织面应作出适当缓冲。磨牙后垫属于边缘封闭区，不是缓冲区。掌握“无牙颌的解剖标志及功能分区”知识点。